釉质中的有机物组成成分为
A. 蛋白和多肽
B. 蛋白质和脂类
C. 蛋白质和糖类
D. 羟磷灰石和脂类
E. 碳磷灰石和糖类

正确答案：B。蛋白质和脂类

解析：釉质中的有机物约占总重量的1%，主要由蛋白质和脂类所组成。基质蛋白主要有釉原蛋白、非釉原蛋白和蛋白酶等三大类。釉原蛋白在釉质晶体的成核及晶体的生长方向和速度调控上发挥着重要作用，在成熟釉质中则基本消失；非釉原蛋白包括釉蛋白、成釉蛋白和釉丛蛋白等。掌握“牙釉质”知识点。